属于牙膏中芳香剂的是
A. 薄荷
B. 丙三醇
C. 苯甲酸盐
D. 二氧化硅
E. 月桂醇硫酸钠

正确答案：A。薄荷

解析：本题考查牙膏的基本成分。牙膏中的芳香剂包括薄荷（A对）、薄荷油、香芹酮、丁香酚等。丙三醇（B错）属于牙膏中的湿润剂。苯甲酸盐（C错）属于牙膏中的防腐剂。二氧化硅（D错）属于牙膏中的摩擦剂。月桂醇硫酸钠（E错）属于牙膏中的洁净剂。